具有散寒止痛，疏肝下气，燥湿，助阳止泻功效的药物是
A. 附子
B. 肉桂
C. 干姜
D. 吴茱萸
E. 高良姜

正确答案：D。吴茱萸

解析：该题考查吴茱萸的功效。吴茱萸味苦，性辛、热，有小毒，入肝、脾、胃、肾经，具有散寒止痛，疏肝下气，燥湿，助阳止泻的功效（D对）。附子具有回阳救逆，补火助阳，散寒止痛的功效（A错）。肉桂具有补火助阳，散寒止痛，温经通脉，引火归原的功效（B错）。干姜具有温中散寒，回阳通脉，温肺化饮的功效（C错）。高良姜具有散寒止痛，温中止呕的功效（E错）。